B细胞形成生发中心，在抗原刺激后
A. 1周左右形成
B. 2周左右形成
C. 3周左右形成
D. 4周左右形成
E. 5周左右形成

正确答案：A。1周左右形成

解析：TD抗原诱导的体液免疫应答：Th细胞对B细胞的辅助作用发生于外周淋巴器官的T细胞区和生发中心。B细胞在Th细胞辅助下活化后进入初级淋巴小结，分裂增殖，形成生发中心（在抗原刺激后1周左右形成）。掌握“B细胞、T细胞介导的免疫应答”知识点。